肝硬化腹水形成的决定性因素是
A. 中心静脉压增高
B. 门静脉高压
C. 醛固酮分泌增加
D. 抗利尿激素增加
E. 肝内淋巴液容量增加和淋巴回流不畅

正确答案：B。门静脉高压

解析：门静脉高压（B对）时，腹腔内脏血管床静水压增高，组织液回吸收减少而涌入腹腔，是腹腔积液形成的决定性因素。醛固酮分泌增加（C错）、抗利尿激素增加（D错）、肝内淋巴液容量增加和淋巴回流不畅（E错）是腹水形成的因素但是都不是决定性因素。中心静脉压增高（A错）与肝硬化腹水形成关系不大。